按照无牙颌组织结构特点，下颌舌骨嵴属于
A. 主承托区
B. 副承托区
C. 边缘封闭区
D. 缓冲区
E. 后堤区

正确答案：D。缓冲区

解析：本题考查无牙颌的功能分区。按照无牙颌组织结构特点，下颌舌骨嵴属于缓冲区（D对），位于下颌骨后部的舌面，其表面覆盖的黏膜较薄，下方有不同程度的倒凹，覆盖此区的基托组织面应适当缓冲。而主承托区（A错）指垂直于（牙合）力受力方向的区域如牙槽嵴顶、腭侧穹窿区、颊棚区等。副承托区（B错）指与（牙合）力受力方向成角度的方向的区域如上下颌牙槽嵴顶的唇、颊和舌腭侧。边缘封闭区（C错）指义齿边缘接触的软组织部分如黏膜皱襞，系带附着部等。后堤区（E错）指上颌义齿后缘的封闭区。